异丙肾上腺素的用途有
A. 抗高血压
B. 缓解支气管哮喘急性发作
C. 预防房室传导阻滞
D. 治疗急性肾衰竭
E. 不能治疗心力衰竭

正确答案：B。缓解支气管哮喘急性发作